非凹陷性水肿面容的常见原因是
A. 肝硬化
B. 肺心病
C. 甲状腺功能减退
D. 慢性肾小球肾炎
E. 急性胰腺炎

正确答案：C。甲状腺功能减退

解析：甲状腺功能减退症是由于结构和功能异常导致甲状腺激素分泌及合成减少或组织利用不足所引起的全身代谢减低临床综合征。病理特征是亲水性的黏蛋白沉积于皮肤和皮下组织、肌肉、内脏等，表现为黏液性水肿，即非凹陷性水肿（C对）。肝硬化临床主要表现为肝功能减退和门静脉高压，晚期可出现多种严重并发症。门脉高压症的特征性表现是侧支循环的建立和开放；肝硬化失代偿期最突出的体征之一是腹水（A错）。慢性肺源性心脏病，简称慢性肺心病，是指慢性肺、胸廓疾病或肺血管病变所引起的肺循环阻力增加、肺动脉高压，进而引起右心室肥厚、扩大，甚至发生右心衰竭的心脏病（B错）。慢性肾小球肾炎，是原发于肾小球的一组疾病。临床特点是病程长，以蛋白尿、血尿、高血压、水肿为基本临床表现，可有不同程度的肾功能减退（D错）。腹痛为急性胰腺炎的首发症状，常于饱餐、饮酒及脂肪餐后突然发作，腹痛剧烈，呈绞痛、钻痛或刀割样，为持续性疼痛伴阵发性加剧（E错）。